有关阿司匹林在心血管病治疗中的作用，下列说法错误的是
A. 可抑制血小板聚集
B. 抑制血管损伤后内膜增生
C. 调节血脂
D. 抑制细胞因子的合成
E. 阻止白细胞的贴壁

正确答案：C。调节血脂

解析：本题考查阿司匹林的药理作用。有关阿司匹林在心血管病治疗中的作用，下列说法错误的是调节血脂（C错，为本题正确答案）。阿司匹林是经典的抗血小板药物，可以通过抑制血小板环氧化酶，导致TXA₂ 生成减少，从而抑制血小板的聚集（A对），所以也可抑制血管损伤后内膜增生（B对）。阿司匹林控制着炎症期间细胞因子表达需要的转录因子，可以抑制细胞因子的合成（D对）。阿司匹林还可以阻止白细胞的贴壁（E对）。